不参与尺桡骨间连结的关节面
A. 桡骨头凹
B. 桡骨头环状关节面
C. 桡骨的尺切迹
D. 尺骨头环状关节面
E. 尺骨的桡切迹

正确答案：A。桡骨头凹

解析：桡骨头凹不参与尺桡骨间连结的关节面（A错，为本题正确答案），桡骨头环状关节面（B对）、桡骨的尺切迹（C对）、尺骨头环状关节面（D对）、尺骨的桡切迹（E对）均参与构成尺桡骨间连结。